将200例某恶性肿瘤患者随机分为两组，分别给子甲，乙两种治疗，并对患者的生存情况进行每年1次，连续6年的随访，其中10例患者失访，采用寿命表法计算得到1年、3年、5年甲法治疗患者生存率分别为95%、79%、65%，乙法治疗患者生存率分别为82%、68%、55%。比较甲、乙两种疗法患者的生存曲线应采用
A. t检验
B. z检验
C. 方差分析
D. 秩和检验
E. log-rank检验

正确答案：E。log-rank检验